28岁，女性，风湿性心脏病二尖瓣狭窄病史5年。平时不用药，登三楼无明显不适。孕5月起活动时常有轻度心慌气促。现孕38周，因心悸，咳嗽，夜间不能平卧，心功能Ⅲ级而急诊入院。在制定治疗计划时，最佳的方案是
A. 积极控制心衰后终止妊娠
B. 积极控制心衰，同时行剖宫产术
C. 积极控制心衰，同时行引产术
D. 适量应用抗生素后继续妊娠
E. 纠正心功能，等待自然临产

正确答案：A。积极控制心衰后终止妊娠

解析：该患者现孕38周（足月妊娠），因心悸，咳嗽，夜间不能平卧，心功能Ⅲ级而急诊入院，原则是积极控制心衰后终止妊娠（A对DE错），应放宽剖宫产指征。若经内科各种治疗措施均未能奏效，继续发展必将导致母、儿的死亡时，可一边控制心力衰竭一边紧急剖宫产（B错），取出胎儿，减轻心脏负担，以挽救孕妇生命。引产术（C错）不能短时间内终止分娩，长时间的宫缩会引起血流动力学改变，加重心脏负担。